精神病患者服用盐酸氯丙嗪后，若在曝光强烈光照下易发生光过敏反应，产生光过敏反应的原因为
A. 氯丙嗪分子中的吩噻嗪环遇光被氧化后，与体内蛋白质发生了反应
B. 氯丙嗪分子中的硫原子遇光被氧化后，与体内蛋白质发生了反应
C. 氯丙嗪分子中的酮-氯键遇光被分解产生自由基，与体内蛋白质发生了反应
D. 氯丙嗪分子中的侧链碳原子遇光被氧化羧基，与体内蛋白质发生了反应
E. 氯丙嗪分子中的侧链氮原子遇光被氧化成N氧化物，与体内蛋白质发生了反应

正确答案：C。氯丙嗪分子中的酮-氯键遇光被分解产生自由基，与体内蛋白质发生了反应

解析：本题考查吩噻嗪类药物氯丙嗪。精神病患者服用盐酸氯丙嗪后，若在曝光强烈光照下易发生光过敏反应，产生光过敏反应的原因为氯丙嗪分子中的酮-氯键遇光被分解产生自由基，与体内蛋白质发生了反应（C对）。盐酸氯丙嗪在使用时，部分患者在日光强烈照射下发生严重的光毒反应，可能是氯丙嗪遇光分解产生的自由基所致。